某患者，男，60岁，主诉吃饭咀嚼无力，要求修复，检查：下颌单侧567缺失，双侧8未萌出，此患者设计为
A. 第一类
B. 第二类的第一亚类
C. 第二类
D. 第四类
E. 第一类的第一亚类

正确答案：C。第二类

解析：第二类：单侧缺隙位于一侧余留牙的远中，即单侧远中游离缺失。【知识点】掌握“局部义齿类型，肯氏分类及模型观测”知识点。